以形象记忆占优势
A. 新生儿期
B. 乳儿期
C. 婴儿期
D. 幼儿期
E. 学龄期

正确答案：C。婴儿期

解析：本题考查不同年龄阶段心理卫生。婴儿期（C对）：3岁以前的儿童称为婴儿。此期的脑重已增至1000克左右，相当于成年人（平均脑重1400克）的2/3。此期是语言发展的关键期。运动功能进一步发展。记忆特点是以无意识记、机械识记、形象记忆占优势。2岁左右有20多种复杂的情绪，3岁左右可以表现出一定的个性特征。